可用于麻风病的治疗
A. 异烟肼
B. 利福平
C. 两者均有
D. 两者均无

正确答案：B。利福平